女，19岁。因急性白血病接受骨髓移植治疗，术后被安置于无菌病房中，根据病情，需限制亲属探视。在此期间患者常常出现心情烦躁、不安。针对此情况，心理治疗师指导其采用冥想结合深呼吸的方法来改善自己的情绪，这种应对方式属于
A. 取得社会支持
B. 消除应激来源
C. 调整认知评价
D. 心理防御机制
E. 自我调节放松

正确答案：E。自我调节放松

解析：心理治疗师指导其采用冥想结合深呼吸的方法来改善患者情绪的应对方式属于自我调节放松（E对）。心理防御机制是指个体面临挫折或冲突的紧张情境时，在其内部心理活动中具有的自觉或不自觉地解脱烦恼，减轻内心不安，以恢复心理平衡与稳定的一种适应性倾向（Ｄ错）。